可用于抗血栓形成、预防冠心病的药是
A. 利多卡因
B. 阿司匹林
C. 阿托品
D. 异丙嗪
E. 金刚烷胺

正确答案：B。阿司匹林

解析：本题考查阿司匹林的作用。阿司匹林（B对）可用于预防心肌梗死和脑血栓。利多卡因（A错）是急性心肌梗死的室性早搏，室性心动过速及室性震颤的首选药。阿托品（C错）主要用于抢救感染中毒性休克、有机磷农药中毒的解救、缓解内脏绞痛、麻醉前给药等。异丙嗪（D错）具有明显的中枢安定作用；适用于各种过敏症、孕期呕吐、乘船等引起的眩晕等。金刚烷胺（E错）可作为流感流行期人群的预防用药。